男，25岁。外伤致胫腓骨骨折，小腿持续性剧烈疼痛。查体：左小腿中段淤血，肿胀严重，压痛明显，足背动脉搏动微弱，足背屈时疼痛剧烈。可能出现的严重并发症是
A. 静脉血栓
B. 脂肪栓塞
C. 神经损伤
D. 血管损伤
E. 骨筋膜室综合征

正确答案：E。骨筋膜室综合征

解析：患者胫腓骨（骨筋膜室综合征好发部位）骨折后，左小腿持续性剧烈疼痛、压痛明显、足背动脉搏动微弱、足背屈时疼痛剧烈（骨筋膜室综合征典型表现），应考虑可能并发骨筋膜室综合征（E对）。静脉血栓（A错）常见于骨折术后长期卧床的病人。脂肪栓塞（B错）常见于肺动脉，表现为突发性呼吸困难。神经损伤（C错）常表现为肢体远端感觉障碍，不会造成肢体的肿胀和血运障碍。患者左小腿淤血，表明有血管损伤，但不严重（D错）。